治疗肾虚型子宫脱垂，应首选的方剂是
A. 大补元煎
B. 归脾汤
C. 八珍汤
D. 举元煎
E. 补中益气汤

正确答案：A。大补元煎

解析：肾虚型子宫脱垂，是由于肾气亏虚，使胞宫失于维系所致，因此宜用具有补肾固脱，益气升提功效的大补元煎（A对）；归脾汤具有益气补血，健脾养心的功效，主治心脾气血两虚证，症见心悸怔忡，健忘失眠，盗汗，体倦食少，面色萎黄，舌淡，苔薄白，脉细弱（B错）；八珍汤具有益气补血之功效，主治气血两虚证，症见面色苍白或萎黄，头晕耳眩，四肢倦怠，气短懒言，心悸怔忡，饮食减少，舌淡苔薄白，脉细弱或虚大无力（C错）；举元煎具有益气升提的功效，主治气虚下陷、血崩血脱、亡阳垂危等证（D错）；补中益气汤具有补益中气，升阳举陷的功效，主治脾虚气陷证，症见纳呆，体倦肢软，少气懒言，面色萎黄，大便稀溏，舌淡，脉虚；以及脱肛、子宫脱垂、久泻久痢，崩漏等（E错）。